属于我国现行国家药品标准的有
A. 《中国药典》
B. 《中国药品检验标准操作规范》
C. 药品注册标准
D. 地方药品标准
E. 企业药品标准

正确答案：A、C。《中国药典》；药品注册标准

解析：本题考查国家药品标准。属于我国现行国家药品标准的有《中国药典》（A对）、药品注册标准（C对）。国家食品药品监督管理局颁布执行的《中华人民共和国药典》、《药品标准》和药品注册标准等三类标准均为国家药品标准。